关于第二信使甘油二酯的叙述，下列哪项正确
A. 由甘油三酯水解而成
B. 进入胞质，起第二信使的作用
C. 只能由磷脂酰肌醇-4，5-二磷酸水解生成
D. 可提高PKC对Ca²⁺的敏感性，激活PKC
E. 只参与腺体的分泌

正确答案：D。可提高PKC对Ca²⁺的敏感性，激活PKC